梅毒下疳可于什么时候自行愈合
A. 感染后第3～8周
B. 感染后第4～9周
C. 感染后第5～10周
D. 感染后第6～11周
E. 感染后第7～12周

正确答案：A。感染后第3～8周

解析：本题考查梅毒下疳自行愈合的时间。梅毒下疳又叫硬下疳，是梅毒螺旋体在侵入部位引起的无痛性炎症反应。潜伏期1周-2个月，平均2-4周。约经3～8周可不治自愈（A对），不留痕迹或遗留暗红色表浅性瘢痕或色素沉着。